男，51岁，父母双亡，未婚，发生车祸后送医就诊，经抢救无效脑死亡，其三个外甥与主治医生商量后决定捐献该患者心脏，肾脏等器官，下列说法正确的是
A. 主治医生可自行摘取患者器官
B. 脑死亡患者不能捐献器官
C. 未婚患者不能捐献器官
D. 外甥无权捐献该患者器官
E. 器官捐献需经患者本人同意

正确答案：D。外甥无权捐献该患者器官

解析：公民生前表示不同意捐献其人体器官的，任何组织或者个人不得捐献、摘取该公民的人体器官（A错）；公民生前未表示不同意捐献其人体器官的，该公民死亡后，其配偶、成年子女、父母可以以书面形式共同表示同意捐献该公民人体器官的意愿（D对）；脑死亡患者有争议（B错）。